Beck三联征是指
A. 血压突然下降，颈静脉显著怒张，心音低钝遥远
B. 血压突然下降，颈静脉显著怒张，心音增强
C. 血压突然下降，颈静脉显著塌陷，心音低钝遥远
D. 血压突然下降，颈静脉显著塌陷，心音增强
E. 血压突然升高，颈静脉显著怒张，心音低钝遥远

正确答案：A。血压突然下降，颈静脉显著怒张，心音低钝遥远

解析：大量心包积液引起心脏压塞时，心室舒张期充盈受阻，周围静脉压升高，导致体循环淤血，而出现颈静脉显著怒张等表现（CD错），也可引起心排血量显著降低，血压突然下降（E错），产生急性心脏压塞的临床表现；大量心包积液使心脏叩诊浊音界向两侧增大，此时听诊多表现为心音低钝遥远（B错）。心脏压塞最典型的临床症状是Beck三联征即血压突然下降，颈静脉显著怒张，心音低钝遥远（A对）。